下列选项中可作为特发性血小板减少性紫癜阴虚火旺证的首选方药的是
A. 桃红四物汤
B. 茜根散
C. 归脾汤
D. 犀角地黄汤
E. 龙胆泻肝汤

正确答案：B。茜根散

解析：特发性血小板减少性紫癜阴虚火旺证证候的机理为久病或热毒之后耗伤阴液，或忧思劳倦，耗伤阴液，或饮食不节，耗伤胃阴，阴液不足，虚火内炽，灼伤血脉，迫血妄行发为紫癜，故其治法当为滋阴降火，清热止血，方药选用滋阴凉血止血的茜根散（B对）。桃红四物汤（A错）养血活血，治疗血虚血瘀证；归脾汤（C错）补气养血，治疗心脾气血两虚证；犀角地黄汤（D错）清热解毒，凉血散瘀，治疗热入血分证；龙胆泻肝汤（E错）清泻肝胆实火，清利肝胆湿热，治疗肝胆实火上炎证或肝胆湿热下注证。